患儿，1岁。突然发热，体温37.8℃，伴咳嗽，流涕，纳差；1天后口腔硬腭颊部黏膜出现疱疹，2天后出现米粒大小皮疹，以手足、臀部为主，部分为疱疹，质地较硬，内有浑浊液体，周围绕有红晕。其诊断是
A. 水痘
B. 风疹
C. 幼儿急疹
D. 手足口病
E. 猩红热

正确答案：D。手足口病

解析：患儿发热、咳嗽、流涕、出疹以手足，臀部为主，部分为疱疹，质地较硬，内有浑浊液体，周围绕有红晕，诊断为手足口病，是由感染病毒所引起（D对）。水痘是由水痘2016U4-带状疱疹病毒初次感染引起的急性传染病。以发热及皮肤和黏膜成批出现周身性红色斑丘疹、疱疹、痂疹为特征，皮疹呈向心性分布，主要发生在胸、腹、背，四肢很少（A错）。风疹临床上以前驱期短、低热、皮疹和耳后、枕部淋巴结肿大为特征（B错）。幼儿急疹其特点是在发热3～5天后热度突然下降，皮肤出现玫瑰红色的斑丘疹，病情减轻，如无并发症可很快痊愈（C错）。猩红热的特殊体征是：杨梅舌、咽峡炎、环口苍白圈、帕氏线（E错）。